体质是指人体的
A. 身体素质
B. 心理素质
C. 身心特性
D. 遗传特质
E. 形态结构

正确答案：C。身心特性

解析：体质，是在先天禀赋和后天获得的基础上所形成的形态结构、生理功能、心理状态方面相对稳定的个性化特征（C对）。体质源于长久的自然进化与适应，因而有着先天与后天的不同。正常的生命活动是形与神的协调统一，正如《类经·藏象类》说：“形神具备，乃为全体。”体质的基本概念，包括形、神两方面的内容，一定的形态结构必然产生相应的生理功能和心理特征，而良好的生理功能和心理特征是正常形态结构的反应，两者相互依存，相互影响，在体质的固有特征中综合地体现出来（ABDE错）。